下列不属于氟喹诺酮类药物的药理学特性是
A. 抗菌谱广
B. 口服吸收好
C. 与其他抗菌药物无交叉耐药性
D. 不良反应较多
E. 体内分布较广

正确答案：D。不良反应较多

解析：氟喹诺酮类药物的药理学特性不良反应较少（D错，为本题正确答案）。体内过程大部分口服吸收迅速而完全（B对），在组织和体液分布较广（E对）。抗菌谱广（A对），可用于治疗泌尿生殖系统感染、呼吸系统感染、肠道感染与伤寒。与其他类别的抗菌药之间较少有交叉耐药反应，C项表述不严谨。